制备软胶丸的方法是
A. 泛丸法
B. 滴丸法
C. 两者均可
D. 两者均不可

正确答案：B。滴丸法

解析：本题考查胶囊剂。滴丸法（B对）可制备软胶丸。泛丸法一般用于制备水丸（ACD错）。